以下不适合用输尿管镜碎石的是
A. 输尿管狭窄
B. 阴性结石
C. 结石停留时间较长
D. 患侧肾积水
E. 肥胖患者

正确答案：A。输尿管狭窄

解析：输尿管镜碎石术（URL）是指经尿道插入输尿管镜，在导丝引导下进入输尿管，直视下用超声、激光或气压弹道等方法碎石。其主要用于中、下段输尿管结石，阴性结石（B错），肥胖（E错）、结石停留时间较长（C错）以及患侧肾积水（D错）等的治疗，不适合有输尿管狭窄（A对）、下尿路梗阻或严重扭曲等的患者。